关于筛检的实施原则，以下说法不正确的是
A. 筛检的目标疾病患病率较高
B. 筛检疾病的自然史清晰
C. 筛检手段简单经济安全、易被受检者接受
D. 对筛检出来的不同结局应有行之有效的处理方案
E. 筛检方法只要能早期诊断疾病即可

正确答案：E。筛检方法只要能早期诊断疾病即可

解析：本题考查筛检的实施原则。筛检的实施原则包括：1.筛检的目标疾病患病率较高（A对）；2.筛检疾病的自然史清晰（B对）；3.筛检手段简单经济安全、易被受检者接受（C对）；4.对筛检出来的不同结局应有行之有效的处理方案（D对）。筛检方法并不是只要能早期诊断疾病即可（E错，为本题正确答案)。